当外阴部发生炎症时，最易形成囊肿的部位是
A. 大阴唇
B. 小阴唇
C. 阴阜
D. 阴蒂
E. 前庭大腺

正确答案：E。前庭大腺

解析：正常情况下不能触及前庭大腺，若腺管口闭塞，易形成脓肿或囊肿（E对）。